我国不少湖泊海湾水域不断发生水体富营养化现象，给当地居民造成巨大的经济损失，仅太湖流域每年因水体富营养化而造成的经济损失就约为50亿元左右。水体富营养化所造成的经济损失主要见于
A. 水产养殖的破坏
B. 农田灌溉造成的作物减产
C. 作为饮水水源带来健康危害
D. 作为工业用水对产品质量的影响
E. 景观破坏

正确答案：A。水产养殖的破坏

解析：本题考查水体富营养化造成的经济损失。水体富营养化会导致水体中氮、磷含量过高，从而使水体中的溶解氧含量降低，水体环境恶化，水体中的水生物繁殖受到影响，从而导致水产养殖的破坏（A对BCDE错）。